蔬菜在烹调中特别容易损失的营养素是
A. 维生素A
B. B族维生素
C. 维生素C
D. 维生素D
E. 蛋白质

正确答案：C。维生素C

解析：本题考查蔬菜在烹调中特别容易损失的营养素。蔬菜在烹调中特别容易损失的营养素是维生素C（C对ABDE错），如蔬菜煮5～10分钟，维生素C损失达70%～90%。